治疗月经先期阳盛血热证，应首选
A. 清经散
B. 逍遥散
C. 当归芍药散
D. 导赤散
E. 柴胡疏肝散

正确答案：A。清经散

解析：月经先期阳盛血热证宜清热凉血调经。清经散的功效为清热养阴，凉血调经，故清经散为月经先期阳盛血热证的选方（A对）。逍遥散用于疏肝解郁，养血健脾，治疗肝气郁结之证（B错）。当归芍药散用于养血安胎止痛，治疗血虚证（C错）。导赤散用于清心利水养阴，治疗心经火热证（D错）。柴胡疏肝散用于疏肝行气，活血止痛，治疗肝气郁滞证（E错）。